临终关怀的伦理意义表现在
A. 它有利于建立和谐社会
B. 它体现生命神圣质量和价值的统一
C. 它理解临终病人的需求
D. 它维护临终病人的生命尊严
E. 它同情和关心临终病人的家属

正确答案：B。它体现生命神圣质量和价值的统一

解析：临终关怀的伦理意义：有利于人类死亡观念的有序嬗变，这种死亡观念的变化体现了生命神圣、质量和价值的统一（B对），是人类死亡文明的巨大进步；有利于医学人道主义的不断升华；有利于社会精神文明的全面进步，临终关怀积极推动着医疗卫生行业乃至整个社会的文明进步；有利于医疗卫生资源的合理分配。